属于白三烯受体阻断剂的平喘药是
A. 孟鲁司特
B. 氟替卡松
C. 噻托溴铵
D. 布地奈德
E. 多索茶碱

正确答案：A。孟鲁司特

解析：本题考查平喘药的分类。属于白三烯受体阻断剂的平喘药是孟鲁司特（A对）。按作用机制来分，平喘药分可为六类：①β₂受体激动剂，包括沙丁胺醇、特布他林、沙美特罗等。②M胆碱受体阻断剂，如异丙托溴铵，噻托溴铵（C错）。③黄嘌呤类药物，如茶碱、氨茶碱、多索茶碱（E错）、二羟丙茶碱等。④过敏介质阻释剂，如肥大细胞膜稳定剂色甘酸钠，H₁受体阻断剂酮替芬等。⑤肾上腺皮质激素，如氢化可的松、布地奈德（D错）、氟替卡松（B错）、倍氯米松等，它们还有抗过敏作用。⑥白三烯调节剂，如孟鲁司特、扎鲁司特、普鲁司特等。